工作人员违反规定，强迫精神障碍患者劳动情节严重的，应给予
A. 警告
B. 降级
C. 责令改正
D. 吊销有关医务人员的执业证书
E. 以上说法均正确

正确答案：D。吊销有关医务人员的执业证书

解析：医疗机构及其工作人员有下列行为之一的，由县级以上人民政府卫生行政部门责令改正，对直接负责的主管人员和其他直接责任人员依法给予或者责令给予降低岗位等级或者撤职的处分；对有关医务人员，暂停6个月以上1年以下执业活动；情节严重的，给予或者责令给予开除的处分，并吊销有关医务人员的执业证书：①违反规定实施约束、隔离等保护性医疗措施的；②违反规定，强迫精神障碍患者劳动的；③违反规定对精神障碍患者实施外科手术或者实验性临床医疗的；④违反规定，侵害精神障碍患者的通讯和会见探访者等权利的；⑤违反精神障碍诊断标准，将非精神障碍患者诊断为精神障碍患者的。掌握“精神障碍康复及法律责任”知识点。